有关静息电位的叙述，哪项是错误的
A. 由K⁺外流所致，相当于K⁺的平衡电位
B. 膜内电位较膜外为负
C. 各种细胞的静息电位数值是不相同的
D. 是指细胞安静时，膜内外电位差
E. 是指细胞安静时，膜外的电位

正确答案：E。是指细胞安静时，膜外的电位